实验室设立单位及其主管部门的职责不包括
A. 负责实验室日常活动的管理
B. 承担建立健全安全管理制度
C. 检查、维护实验设施、设备
D. 控制实验室感染
E. 主管与人体健康有关的实验室及其实验活动的生物安全监督工作

正确答案：E。主管与人体健康有关的实验室及其实验活动的生物安全监督工作